患者，女性，65岁，因阵发性胸闷8年，持续胸痛8小时收入院。入院时血压为150/90mmHg，诊断急性前壁心肌梗死。住院第2日患者出现胸闷、大汗、面色苍白，体检心率126次/分，律齐，双肺未闻及干湿性啰音，血压90/60mmHg，考虑合并心源性休克。此时不宜用
A. 主动脉内气囊反搏术
B. 静注速尿
C. 静滴多巴胺
D. 静滴多巴酚丁胺
E. 皮下注射低分子肝素

正确答案：B。静注速尿

解析：患者老年女性，诊断为急性前壁心肌梗死合并心源性休克，患者血压90/60mmHg，考虑血容量不足，可用右旋糖酐40或5%～10%葡萄糖液静脉滴注。若补充血容量后血压仍不升，而PCWP和CI正常时，提示周围血管张力不足，可静滴多巴胺（C对）或静滴多巴酚丁胺（D对）升高血压。有条件的医院可使用主动脉内气囊反搏术（A对）进行辅助循环，随即施行介入治疗或主动脉-冠状动脉旁路移植手术，可挽救一些患者的生命。若此时使用利尿剂，可使循环血量减少，加重休克症状（B错，为本题正确答案）。皮下注射低分子肝素（P242）（E对）为急性心肌梗死患者常规抗凝治疗。